以下哪种方法是一种窝沟封闭与窝沟龋充填相结合的预防性措施
A. 预防性树脂充填
B. 非创伤性修复
C. 点隙裂沟封闭
D. 烤瓷熔附金属全冠修复
E. 嵌体预备

正确答案：A。预防性树脂充填

解析：预防性树脂充填术即对小的窝沟龋和窝沟可疑龋进行树脂充填术，这是一种窝沟封闭与窝沟龋充填相结合的预防性措施。掌握“预防性树脂充填”知识点。